患儿，5岁，右下乳磨牙（牙合）面龋坏，未有自发痛和叩击痛，医生决定采用玻璃离子材料ART修复该牙，并告知患儿家长，患儿不能用该牙咀嚼的时间是修复后
A. 半小时内
B. 1小时内
C. 5小时内
D. 12小时内
E. 24小时内

正确答案：B。1小时内

解析：非创伤性修复治疗（ART）指使用手用器械清除龋坏组织，然后用有黏结性、耐压和耐磨性能较好的新型玻璃离子材料将龋洞充填。需一定时间才能固化，充填治疗后患者1小时内不能用该牙咀嚼。银汞合金充填后24小时内不宜用患牙咀嚼。掌握“非创伤性修复治疗”知识点。